患者，20岁，男性，右上后牙遇冷水痛近2月。检查见右上第一磨牙咬面深龋洞达牙本质深层，探痛明显且有穿髓孔，叩诊（±），冷测敏感，刺激去除后疼痛持续一段时间，该患牙应诊断为
A. 深龋
B. 可复性牙髓炎
C. 慢性牙髓炎
D. 牙本质过敏
E. 中龋

正确答案：C。慢性牙髓炎

解析：慢性溃疡性牙髓炎：探查洞底有穿髓孔，有探痛；对温度测验的反应可迟钝或敏感；叩诊轻度疼痛或不适；X线片检查可有根尖周牙周膜间隙增宽或硬骨板模糊等改变。掌握“可复性、急慢性牙髓炎”知识点。